关于慢性化脓性唾液腺炎的发病因素说法错误的一项
A. 可由结石、异物、瘢痕挛缩等堵塞导管所致
B. 可因放射线损伤后继发感染所致
C. 可由急性唾液涎腺炎转变而来
D. 长期口吹乐器容易引致逆行感染
E. 为自身免疫性疾病

正确答案：E。为自身免疫性疾病

解析：慢性化脓性唾液腺炎可由结石、异物、瘢痕挛缩等堵塞导管和放射线损伤后继发感染而发病；也可由急性唾液腺炎进展而来。长期口腔内压力增高如口吹乐器等，可逆行感染发生慢性唾液腺炎。掌握“慢性唾液腺炎的病理变化”知识点。